去甲肾上腺素可引起
A. 血压升高
B. 瞳孔扩大
C. 骨骼肌松弛
D. 腺体分泌增加
E. 心脏兴奋性下降

正确答案：A。血压升高